患者壮热，面赤，汗多，渴喜饮，舌红苔黄燥，脉洪大。其证型是
A. 阳明热盛
B. 热郁胸膈
C. 热灼营阴
D. 热郁胆腑
E. 阳明热结

正确答案：A。阳明热盛

解析：里热炽盛，弥漫全身，蒸腾于外，故见壮热；气血涌盛于面，故面赤；邪热炽盛，迫津外泄，故汗多；热盛伤津，且汗出复伤津液，故渴喜饮；舌红苔黄燥，脉洪大，为阳明里热炽盛之象，故其证候为阳明热盛证（即阳明经证）（A对）。热郁胸膈（B错）证候表现为身热不甚，心烦懊，坐卧不安，欲呕不得呕，舌红，苔黄，脉滑数。热灼营阴（C错）证候表现为身热夜甚，心烦躁扰，甚或时有谵语，舌质红降而干，苔薄或无苔，脉细数。热郁胆腑（D错）证候表现为身热，口苦而渴，干呕，心烦，小便短赤，或胸胁不舒，舌红，苔黄，脉象弦数。阳明热结（E错）证，证候表现为日晡潮热，手足濈然汗出，脐腹胀满硬痛而拒按，大便秘结不通，脉沉迟而实。